使患者的患者角色发生反复的是
A. 角色行为异常
B. 角色行为冲突
C. 角色行为适应
D. 角色行为强化
E. 角色行为减退

正确答案：B。角色行为冲突

解析：角色行为冲突：这是指个体在适应患者角色过程中与其病前的各种角色发生心理冲突，使患者焦虑不安、烦恼，甚至痛苦。人在社会生活中是多种社会角色的综合体，患病意味着不能承担正常的社会角色。当某种社会角色的重要性、紧迫性凸显时，患者就容易发生心理冲突。这些心理冲突有时较激烈，使患者的患者角色发生反复。掌握“患者角色和求医行为”知识点。